可治疗癫痫大发作的是
A. 麝香
B. 苏合香
C. 冰片
D. 石菖蒲
E. 苏冰滴丸

正确答案：D。石菖蒲

解析：本题考查的是石菖蒲的主治病证。可治疗癫痫大发作的是石菖蒲（D对）。石菖蒲：【主治病证】（1）痰湿蒙蔽心窍之神昏，癫痫，耳聋，耳鸣。（2）心气不足之心悸失眠、健忘恍惚。（3）湿浊中阻之脘腹痞胀，噤口痢。麝香（A错）：【主治病证】（1）热病神昏，中风痰厥，气郁暴厥，中恶神昏。（2）闭经，癥瘕，难产死胎。（3）胸痹心痛，心腹暴痛，痹痛麻木，跌打损伤。（4）疮肿，瘰疬，咽喉肿痛。苏合香（B错）：【主治病证】（1）寒闭神昏。（2）胸痹心痛，胸闷腹痛。冰片（C错）：【主治病证】（1）热病神昏，中风痰厥，中恶神昏，胸痹心痛。（2）疮疡肿毒，咽喉肿痛，口舌生疮，目赤肿痛，耳道流脓。苏冰滴丸（E错）的功能，2022年考试指南未明确说明。